必须持有《药品经营许可证》的企业是
A. 经营处方药的批发企业
B. 经营非处方药的批发企业
C. 经营处方药的零售企业
D. 经营甲类非处方药的零售企业
E. 经营乙类非处方药的零售企业

正确答案：A、B、C、D。经营处方药的批发企业；经营非处方药的批发企业；经营处方药的零售企业；经营甲类非处方药的零售企业

解析：本题考查药品经营管理。必须持有《药品经营许可证》的企业是经营处方药的批发企业（A对）、经营非处方药的批发企业（B对）、经营处方药的零售企业（C对）、经营甲类非处方药的零售企业（D对）。开办药品批发企业，须经企业所在地省、自治区、直辖市人民政府药品监督管理部门批准并发给《药品经营许可证》。开办药品零售企业，须经企业所在地县级以上地方药品监督管理部门批准并发给《药品经营许可证》。无《药品经营许可证》的，不得经营药品。